刚从干洗店取回来的衣物必须放在干燥通风处，使其含有的干洗剂完全挥发后，才能存放在衣柜或穿戴，减少或避免对人体健康产生影响，这种干洗剂主要指
A. 四氯乙烯
B. 三氯乙烷
C. 氯乙烯
D. 乙烯
E. 乙烷

正确答案：A。四氯乙烯

解析：本题考查干洗店使用的干洗剂。干洗店使用的干洗剂是三氯乙烯或四氯乙烯（A对BCDE错），这种溶剂能被衣服纤维吸附，待衣服干燥时可从衣服内释放出来，污染居室内空气。这是一种对人体有毒性的溶剂，过量吸入后，可引起呼吸困难和心律不齐等症状。研究表明，这种干洗剂可能具有致癌性，且对婴幼儿危害更大。因此，刚从干洗店取回来的衣物必须放在干燥通风处，使其含有的干洗剂完全挥发后，才能存放在衣柜或穿戴，减少或避免对人体健康产生影响。